宫颈癌的主要转移途径是
A. 直接蔓延
B. 淋巴转移
C. 血行转移
D. 直接蔓延和种植
E. 直接蔓延和淋巴转移

正确答案：E。直接蔓延和淋巴转移

解析：第九版妇产科说明，直接蔓延是最常见转移途径。第九版病理学说明，淋巴道转移是子宫颈癌最常见和最重要的转移途径，首先转移至子宫旁淋巴结，然后依次至闭孔、髂内、髂外、髂总、腹股沟及骶前淋巴结，晚期可转移至锁骨上淋巴结。两本教材关于宫颈癌最常见转移途径有冲突，题干中是最主要转移途径，根据第九版妇产科教材的原文，主要为直接蔓延和淋巴转移（E对）。